马拉硫磷对雄性大鼠经口LD₅₀为521mg/kg，而雌性大鼠经口LD₅₀为1000mg/kg
A. 实验动物的物种与毒效应
B. 实验动物的品系与毒效应
C. 实验动物的性别与毒效应
D. 实验动物的年龄与毒效应
E. 实验动物的生理营养状况与毒效应

正确答案：C。实验动物的性别与毒效应